风险分析体系的核心和基础是
A. 风险评估
B. 风险管理
C. 风险交流
D. 风险控制
E. 危害识别

正确答案：A。风险评估